下列各项可出现双侧瞳孔散大的是
A. 阿托品影响
B. 氯丙嗪影响
C. 有机磷农药中毒
D. 毒蕈中毒
E. 毛果芸香碱中毒

正确答案：A。阿托品影响

解析：正常瞳孔直径为2～5mm，双侧等大等圆。阿托品影响（A对）可导致双侧瞳孔散大。氯丙嗪影响（B错）、有机磷农药中毒（C错）、毒蕈中毒（D错）、毛果芸香碱中毒（E错）均可导致双侧瞳孔缩小。